发生肺血栓栓塞时，应首先考虑溶栓的情况是
A. 严重低氧血症
B. 剧烈胸痛
C. 持续低血压
D. 合并深静脉血栓形成
E. 明显咯血

正确答案：C。持续低血压

解析：肺血栓栓塞需要溶栓的指标应达到PTE中危及以上标准，此时患者有心功能不全不能代偿，表现为持续低血压（C对）。肺栓塞患者出现严重低氧血症（A错）、剧烈胸痛（B错）、明显咳血（E错）时，不一定合并持续低血压。合并深静脉血栓形成（D错）不是溶栓适应症。